称为血管化游离骨移植术的是
A. 单纯游离骨移植术
B. 成形性松质骨移植术
C. 带肌蒂的骨移植术
D. 血管吻合游离骨移植术
E. 多元性游离骨移植术

正确答案：D。血管吻合游离骨移植术

解析：血管吻合游离骨移植术也称血管化游离骨移植术。掌握“骨移植”知识点。